结脉和促脉的主要不同点，在于
A. 脉位的浮沉
B. 脉力的大小
C. 脉形的长短
D. 脉率的快慢
E. 脉律的齐否

正确答案：D。脉率的快慢

解析：结脉的脉象特点是脉来迟缓，脉律不齐，有不规则的歇止，《脉经》曰：“结脉往来缓，时一止复来”，《诊家正眼》称结脉是“迟滞中时见一止”；促脉的脉象特点是脉来急促，节律不齐，有不规则的歇止，《脉经》云：“促脉来去数，时一止复来”，故结脉和促脉的主要不同点在于脉率的快慢（D对）。濡脉和弱脉的主要不同点在于脉位的浮沉（A错）。濡脉和弱脉的主要不同点在脉力的大小（B错）。长脉与短脉的主要不同点在于脉形的长短（C错）。结脉和代脉的主要不同点在于脉率的齐否（E错）。